常用于后牙游离端缺失，基牙为前磨牙或尖牙的卡环
A. 圈形卡环
B. 回力卡环
C. 对半卡环
D. RPI卡坏
E. 三臂卡环

正确答案：B。回力卡环

解析：回力卡环：常用于后牙游离端缺失，基牙为前磨牙或尖牙，牙冠较短或为锥形牙。RPI卡环（D错）组由近中（牙合）支托、邻面板、Ⅰ杆三部分组成，常用于远中游离端缺失者。掌握“局部义齿固位体”知识点。